艾滋病病毒主要侵害人体细胞中的
A. 中性粒细胞
B. 淋巴细胞
C. 抑制性T细胞
D. 辅助性T细胞
E. 巨噬细脑

正确答案：D。辅助性T细胞

解析：HIV-1感染人体的靶细胞是CD⁴⁺淋巴细胞即辅助性T细胞（D对），它通过感染免疫系统的中枢细胞CD⁴⁺淋巴细胞，激发异常的免疫反应，诱导有利于病毒繁殖的细胞因子微环境来扰乱整个免疫系统；HIV主要侵犯免疫系统，对中性粒细胞（A错）影响不大；淋巴细胞（B错）包括T淋巴细胞和B淋巴细胞，范围太大，HIV主要侵犯T淋巴细胞；抑制性T细胞（C错）具有对HIV特异的细胞溶解能力，在HIV感染初期具有抗病毒作用；巨噬细胞（E错）在HIV感染的免疫致病方面具有关键作用，能够辅助细胞免疫和体液免疫，还能辅助NK细胞的活性，具有抗HIV作用。